能抑制外周（甲状腺外）T₄转化为T₃的抗甲状腺药物是
A. 甲巯咪唑
B. 卡比马唑
C. 美托洛尔
D. 丙硫氧嘧啶
E. 左甲状腺素

正确答案：D。丙硫氧嘧啶

解析：本题考查丙硫氧嘧啶。能抑制外周（甲状腺外）T₄转化为T₃的抗甲状腺药物是丙硫氧嘧啶（D对）。丙硫氧嘧啶抗甲状腺作用的机理包括抑制甲状腺过氧化物酶，阻止碘离子氧化；不影响已合成的T₃、T₄释放与利用；在周围组织中抑制T₄转化成T₃。甲巯咪唑（A错）属于硫脲类抗甲状腺药，通过抑制甲状腺素激素的合成来治疗甲状腺功能亢进症，甲巯咪唑并不阻断甲状腺和血液循环中已有的甲状腺素（T₄）和三碘甲状腺原氨酸（T₃）的作用。卡比马唑（B错）为抗甲状腺药物，其作用机制是抑制甲状腺内过氧化物酶，从而阻碍吸聚到甲状腺内碘化物的氧化及酪氨酸的偶联，阻碍甲状腺素（T₄）和三碘甲状腺原氨酸（T₃）的合成。美托洛尔（C错）属于β-受体阻断剂，主要通过抑制过度激活的交感神经活性、抑制心肌收缩力、减慢心率发挥降压作用，尤其适用于伴快速性心律失常、冠心病心绞痛、慢性心力衰竭、交感神经活性增高以及高动力状态的高血压患者。左甲状腺素（E错）为甲状腺激素类药，为人工合成的四碘甲状腺原氨酸，常用其钠盐，此药比较稳定，价格较便宜。L-T₄在体内可转变为T₃，故血中T₃亦可较高。